下列哪项不是灭菌方法
A. 预真空压力蒸汽灭菌
B. 干热160℃及以上灭菌
C. 环氧乙烷灭菌
D. 大剂量紫外线照射
E. 大量医用酒精浸泡

正确答案：E。大量医用酒精浸泡

解析：灭菌方法主要有预真空压力蒸汽灭菌、干热160℃及以上灭菌、环氧乙烷灭菌和辐射灭菌（大剂量紫外线照射）等。掌握“牙髓根尖周病的治疗总论”知识点。